下列哪一类生产性有害因素与职业性皮炎关系最密切
A. 有机溶剂
B. 粉尘
C. 辐射
D. 苯的氨基硝基化合物

正确答案：A。有机溶剂

解析：本题考查职业性皮炎致病因素。由有机溶剂（A对BCD错）所致的职业性皮炎，约占总例数的20%。通常对皮肤有脱脂、溶脂作用和刺激性。典型溶剂皮炎具有急性刺激性皮炎的特征，如红斑和水肿，亦可见慢性裂纹性湿疹。有些工业溶剂能引起过敏性接触性皮炎。三氯乙烯等少数有机溶剂甚至可诱发严重的剥脱性皮炎。